以下哪项不是基托作缓冲的目的
A. 防止压痛
B. 防止有碍发音
C. 防止压迫龈组织
D. 防止压伤黏膜组织
E. 防止基托翘动

正确答案：B。防止有碍发音

解析：本题考查基托作缓冲的目的。缓冲区指需要缓冲咀嚼压力的区域。发音障碍主要是因为牙排列的位置不正确或基托前部没有形成腭皱和切牙的乳突形态，与基托作缓冲无关（B错，为本题的正确答案）。缓冲区主要指上颌隆突、切牙乳突等部位，该部位上面覆盖很薄的黏膜，不能承受咀嚼压力。应将上述各部位的义齿基托组织面的相应部位磨除少许，做缓冲处理，以免功能运动时压迫龈组织（C对）、压伤黏膜组织（D对）、产生压痛（A对）。无牙颌的骨性隆突部位，如上颌隆突、颧突、上颌结节颊侧、下颌隆突、下颌舌骨嵴以及牙槽嵴上的骨尖、骨棱等部位，表面被覆黏膜较薄，切牙乳突内有神经和血管。这些部位均不能承受咀嚼压力，全口义齿基托组织面在上述的相应部位应做缓冲处理，以免因压迫导致疼痛，或形成支点而使基托翘动（E对）。